用整体铸造法或焊接法将固位体与桥体连接成整体称为
A. 嵌体
B. 桥体
C. 固位体
D. 固定连接体
E. 活动的连接体

正确答案：D。固定连接体

解析：连接体：是固定桥桥体与固位体之间的连接部分。1）用整体铸造法或焊接法将固位体与桥体连接成整体，形成固定连接体。2）通过桥体一端的栓体与固位体一端的栓道相嵌合，形成可活动的连接体。掌握“固定桥的组成和分类”知识点。